关于中药材专业市场管理的说法，正确的有
A. 中药材专业市场严禁从事中药饮片分包装活动
B. 建立流通追溯系统的专门从事中药材批发业务的企业，可以允许进入中药材专业市场经营国家规定的毒性药材
C. 未经批准不得在中药材专业市场以任何名义或方式经营中药饮片和中成药
D. 中药材专业市场应逐步建立起公司化的中药材经营模式

正确答案：A、C、D。中药材专业市场严禁从事中药饮片分包装活动；未经批准不得在中药材专业市场以任何名义或方式经营中药饮片和中成药；中药材专业市场应逐步建立起公司化的中药材经营模式

解析：本题考查的是中药材专业市场管理。关于中药材专业市场管理的说法，正确的有中药材专业市场严禁从事中药饮片分包装活动（A对）、未经批准不得在中药材专业市场以任何名义或方式经营中药饮片和中成药（C对）与中药材专业市场应逐步建立起公司化的中药材经营模式（D对）。中药材专业市场管理：《药品管理法》及其实施条例规定，城乡集市贸易市场可以出售中药材，国务院另有规定的除外。另外，《关于进一步加强中药材管理的通知》指出：除现有17个中药材专业市场外，各地一律不得开办新的中药材专业市场。中药材专业市场所在地人民政府要按照“谁开办，谁管理”的原则，承担起管理责任，明确市场开办主体及其责任。中药材专业市场要建立健全交易管理部门和质量管理机构，完善市场交易和质量管理的规章制度，逐步建立起公司化的中药材经营模式。要构建中药材电子交易平台和市场信息平台，建设中药材流通追溯系统，配备使用具有药品现代物流水平的仓储设施设备，提高中药材仓储、养护技术水平，切实保障中药材质量。严禁销售假劣中药材，严禁未经批准以任何名义或方式经营中药饮片、中成药和其他药品，严禁销售国家规定的27种毒性药材（B错），严禁非法销售国家规定的42种濒危药材。中药材市场经营者应完善购进记录、验收、储存、运输、调剂、临方炮制等过程的管理制度和措施。严禁从事饮片分包装、改换标签等活动。严禁从中药材市场或其他不具备饮片生产经营资质的单位或个人采购中药饮片，确保中药饮片安全。市场监督管理部门要指导市场开办单位建立各项市场管理制度，规范经营行为，国家规定禁止进入市场的中成药及有关药品严禁进入中药材市场，查处制售假冒伪劣药品的行为，维护市场经营秩序。